芦荟除泻下外，又能
A. 清肝，杀虫
B. 清心，利尿
C. 清肺，化痰
D. 清胃、止呕
E. 清胆、截疟

正确答案：A。清肝，杀虫

解析：本题考查的是芦荟的功效。芦荟除泻下外，又能清肝，杀虫（A对）。芦荟：【功效】泻下，清肝，杀虫。灯心草：【功效】利尿（B错）通淋，清心除烦。瓜蒌：【功效】清肺润燥化痰（C错），利气宽胸，消肿散结，润肠通便。芦根：【功效】清热生津，除烦止呕（D错），利尿。功能为清胆、截疟（E错）的中药，2022年考试指南未明确说明。